作为理想的饮用水水源首选为
A. 降水
B. 水库水
C. 江河水
D. 深层地下水
E. 浅层地下水

正确答案：D。深层地下水

解析：本题考查理想的饮用水水源。深层地下水（D对ABCE错）是指在第一个不透水层以下的地下水，其水质较好，水量较稳定，常作为理想的饮用水水源首选。